下列哪种材料对牙髓刺激性小且可促进牙本质形成
A. 磷酸锌水门汀
B. 聚羧酸水门汀
C. 玻璃离子水门汀
D. Ca（OH）₂糊剂
E. 银汞合金

正确答案：D。Ca（OH）₂糊剂

解析：本题考查对牙髓刺激性小且可促进牙本质形成的水门汀。Ca（OH）₂糊剂（D对）盖髓时，可促进修复性牙本质形成，保护牙髓免受刺激。磷酸锌水门汀（A错）的酸性可刺激牙髓，对正常健康的牙齿，牙髓反应是完全可逆的，而对因创伤而压力增大的牙髓，会造成牙髓坏死，且不能促进牙本质的形成。聚羧酸锌水门汀（B错）呈较强的酸性，但其含有的聚丙烯酸不易析出，很难渗入牙本质小管，所以对牙髓刺激性较小，但是不能促进牙本质的形成。玻璃离子水门汀（C错）与聚羧酸锌水门汀相似，对牙髓刺激性较小，但是不能促使牙本质的形成。银汞合金充填体（E错）本身对牙髓刺激极小，由于其传导性，受到冷热刺激会引起牙髓疼痛，同时对牙本质形成的促进作用不如氢氧化钙。